某药物的生物半衰期约为8h，其临床治疗的最低有效浓度约为10㎍/ml，当血药浓度达到30㎍/ml时，会产生不良反应。关于该药物给药方案设计依据的说法，正确的是
A. 不考虑稳态血药浓度，仅根据药物半衰期进行给药
B. 根据最小稳态血药浓度不小于10㎍/ml，且最大稳态血药浓度小于30㎍/ml给药
C. 根据平均稳态浓度为20㎍/ml给药
D. 根据最小稳态血药浓度不小于10㎍/ml给药
E. 根据最大稳态血药浓度小于30㎍/ml给药

正确答案：B。根据最小稳态血药浓度不小于10㎍/ml，且最大稳态血药浓度小于30㎍/ml给药

解析：本题考查药物给药方案设计。该药物给药方案设计依据：根据最小稳态血药浓度不小于10㎍/mL，且最大稳态血药浓度小于30㎍/mL给药（B对）。为达到安全有效的治疗目的，根据患者情况和药物的药效学与药动学特点而拟订的药物治疗计划称给药方案。它包括药物与剂型、给药剂量、给药间隔和疗程等。给药方案设计的目的是使药物在靶部位达到最佳治疗浓度，产生最佳的治疗作用和最小的副作用。对于治疗指数小的药物，要求血药浓度的波动范围在最小中毒浓度与最小有效浓度之间。对于在治疗剂量即表现出非线性动力学特征的药物，剂量的微小改变，可能会导致治疗效果的显著差异，甚至会产生严重毒副作用，此类药物也需要制定个体化给药方案。给药方案设计和调整，常常需要进行血药浓度监测。但血药浓度监测仅在血药浓度与临床疗效相关，或血药浓度与药物副作用相关时才有意义。